关于土壤的环境质量标准不正确的是
A. 制订土壤环境质量标准的影响因素包括土壤因素和受体因素
B. 土壤环境质量标准的制定原则应基于保护陆地生态安全和人体健康
C. 我国现行的《土壤环境质量标准》根据土壤功能和保护目标划分为三类
D. 地球化学法和生态效应法是制定土壤环境质量标准的两种基本技术路线
E. 我国依据上述两种技术路线，把土壤环境质量划分为2个等级

正确答案：E。我国依据上述两种技术路线，把土壤环境质量划分为2个等级

解析：本题考查土环境质量标准。土壤环境质量标准是国家为防止土壤污染、保护生态系统、维护人体健康所制订的土壤中污染物在一定的时间和空间范围内的容许含量值。制订土壤环境质量标准的影响因素有两个方面：一是土壤因素，由于受气候、成土母质、地形、生物、时间和人为活动的深刻影响，土壤类型和性质的不同，因此同一污染物在不同土壤中的活性也有差异；二是受体因素（A对），土壤中同一污染物对各类受体（植物、微生物、动物，人体以及水体、大气等）的影响是不同的，并且同一受体又有地区的差别。土壤环境质量标准的制定原则应基于保护陆地生态安全和人体健康（B对）。我国现行的《土壤环境质量标准》根据土壤功能和保护目标划分为三类（C对），规定不同应用功能的土壤执行不同标准值。地球化学法和生态效应法是制定土壤环境质量标准的两种基本技术路线（D对），我国依据上述两种技术路线，把土壤环境质量划分为3个等级（E错，为本题正确答案）。其中，第一级标准主要是依据土壤背景值，即地球化学法进行制定的。第二、三级标准主要依据生态效应法制订，所不同的是第二级标准的制订是从全国范围内选用诸多类型土壤中最小的土壤环境基准值作为二级标准，而第三级标准是根据国内某些高污染物含量但尚未发生危害地区土壤（或人工外源污染的试验资料）制订的。